下列哪项不是颞下颌关节可逆性保守治疗的原则
A. 药物治疗
B. 理疗
C. 局部封闭
D. 正畸矫治
E. 咬合板

正确答案：D。正畸矫治

解析：颞下颌关节紊乱以保守治疗为主，采用对症治疗和消除或减弱致病因素相结合的综合治疗。治疗程序应先用可逆性保守治疗，如药物治疗、理疗、封闭和咬合板等；然后用不可逆性保守治疗，如调（牙合）、正畸矫治等；最后选用关节镜外科和各种手术治疗。掌握“颞下颌关节紊乱”知识点。